用沉淀重量法测定硫酸根的含量时，可用氯化钡为沉淀剂，与硫酸根形成硫酸钡沉淀，沉淀经过滤、洗涤并干燥至恒重后，精密称定硫酸钡（BaS0₄）的重量，即可计算硫酸根（SO₄²⁻）量。用M表示分子量，则换算因数（F）为
A. MBaSO₄/MSO₄²⁻
B. MBaSO₄/2SO₄²⁻
C. MSO₄²⁻/MBaSO₄
D. 2SO₄²⁻/MBaSO₄
E. 2SO₄²⁻/MBa²⁺

正确答案：C。MSO₄²⁻/MBaSO₄